长期使用可使血钾水平升高的药品是
A. 氨苯蝶啶
B. 呋塞米
C. 吲达帕胺
D. 乙酰唑胺
E. 氢氯噻嗪

正确答案：A。氨苯蝶啶

解析：本题考查氨苯蝶啶的不良反应。长期使用可使血钾水平升高的药品是氨苯蝶啶（A对）。氨苯蝶啶为保钾利尿药，常见不良反应为高钾血症。呋塞米（B错）、吲达帕胺（C错）和氢氯噻嗪（E错）均可发生低钾血症的不良反应。乙酰唑胺（D错）是碳酸酐酶抑制剂，常见代谢性酸中毒、肾结石等不良反应。